慢性增生性牙髓炎常发生在
A. 乳磨牙
B. 第二恒磨牙
C. 乳切牙
D. 将要替换的乳尖牙
E. 第一前磨牙

正确答案：A。乳磨牙

解析：本题考查慢性增生性牙髓炎。慢性增生性牙髓炎常发生在乳磨牙（A对）。慢性增生性牙髓炎又称为牙髓息肉，多见于儿童及青少年，常发生在乳磨牙或第一恒磨牙。